氧自由基的主要作用
A. 引起发热
B. 起趋化作用
C. 使血管通透性升高
D. 导致疼痛
E. 加重组织损伤

正确答案：E。加重组织损伤

解析：中性粒细胞和巨噬细胞受到微生物、免疫复合物、细胞因子或其他炎症因子刺激后，可合成和释放氧自由基（活性氧），少量的氧自由基释放可增强和放大炎症反应，但大量的氧自由基释放则会加重组织损伤（E对）。可引起发热（A错）的炎症介质有细胞因子IL-1、TNF、前列腺素等。起趋化作用（B错）的炎症介质为趋化因子（P69），如细菌产物、C5a、LTB4等。可使血管通透性升高（C错）的炎症介质有组胺和5-羟色胺等。可导致疼痛（D错）的炎症介质有前列腺素、缓激肽、P物质等。